女，28岁。停经3个月，早孕反应消失，阴道少许流血2天。妇科检查：宫口闭，子宫如妊娠8周大，质软，双侧附件区未触及异常。为明确诊断，首选的检查是
A. 腹部CT检查
B. 多普勒超声检查
C. B超检查
D. 诊断性刮宫
E. 血孕酮测定

正确答案：C。B超检查

解析：该孕妇28岁，停经3个月，早孕反应消失，阴道少许流血2天（稽留流产表现为早孕反应消失，有先兆流产症状或无任何症状，先兆流产主要表现为停经后阴道少量流血和阵发性腹痛），宫口闭（稽留流产妇科检查宫颈口未开），子宫如妊娠8周大（稽留流产子宫小于停经周数，但大于正常非孕子宫），双侧附件区未触及异常，最可能诊断为稽留流产。为明确诊断，首选的检查是B型超声检查（C对）。稽留流产时胚胎或胎儿死亡滞留于宫腔内，无胎心搏动，B型超声检查可确诊。腹部CT检查（A错）与B型超声检查比，观察不够直接，不作为首选的检查。多普勒超声检查（B错）主要用于观察器官血流速度和血流状态。诊断性刮宫（P50）（D错）适用于晚期难免流产和不全流产者。血孕酮测定（P50）（E错）用于协助判断先兆流产的预后。